患者20岁，1小时前外伤，上前牙自觉变短，要求治疗。查：左上1牙冠比邻牙短3mm，牙冠完整，叩诊（+），牙龈轻度红肿，X线：根尖周膜消失。该牙处理为
A. 待其自然萌出，定期观察
B. 复位后固定，定期观察
C. 牙髓治疗后复位固定
D. 复位固定4周后，牙髓治疗
E. 拔除

正确答案：B。复位后固定，定期观察

解析：本题考查牙脱位的治疗。患者20岁，1小时前外伤，上前牙自觉变短，要求治疗。查：左上1牙冠比邻牙短3mm，牙冠完整，叩诊（+），牙龈轻度红肿，X线：根尖周膜消失。该牙处理为复位后固定，定期观察（B对）。根据病例描述，外伤后左上1牙冠比邻牙短3mm，牙冠完整，叩诊（+），牙龈轻度红肿，X线：根尖周膜消失，可考虑诊断为左上1嵌入性牙脱位。患者20岁，左上1根尖已发育完全，故应该应在复位后2周行根管治疗，综合选项，将患牙复位后固定，定期观察为选项中最优解。对于嵌入性脱位牙的年轻恒牙，应待其自然萌出，定期观察（A错）。牙完全脱位2小时以后再就诊者，牙髓和牙周膜已经坏死，应在体外进行根管治疗后，再将患牙植入固定（C错）。牙完全脱位若就诊迅速并及时复位，应复位固定3～4周后进行根管治疗（D错）。该患牙完整，待其治疗后可正常使用，应该保留，不能拔除（E错）。